肝脏在脂肪代谢中产生过多酮体主要由于
A. 肝功能不好
B. 肝中脂肪代谢障碍
C. 脂肪转运障碍
D. 脂肪摄食过多
E. 糖的供应不足或利用障碍

正确答案：E。糖的供应不足或利用障碍